内寒病机多见于
A. 心肝肾
B. 心脾肾
C. 肝脾肾
D. 肺胃肾
E. 肺肝脾

正确答案：B。心脾肾

解析：该题考查内寒病机涉及脏腑，理解记忆即可。“内寒病机主要与脾肾阳虚有关” ，且心阳虚，温运无权，鼓动血行功能减弱，血行滞缓所致内寒（B对）。运用排除法，肝病以阳亢为多见，阳盛则热不会出现内寒，ACE错。肺病以气虚为多见（D错）。